依照《医疗机构制剂配制质量管理规范（试行）》，制剂配制的管理文件主要有
A. 质量标准、检验操作规程、制剂质量稳定性考察记录和检验记录
B. 配制规程、检验操作规程和检验记录
C. 配制记录和检验记录
D. 配制规程、标准操作规程和配制记录
E. 配制规程和制剂质量稳定性考察记录

正确答案：C。配制记录和检验记录